女，30岁，人工流产术后闭经7个月，无腹痛，既往月经规律，尿妊娠试验阴性，基础体温双相型，最可能的诊断是
A. Asherman综合征
B. Sheehan综合征
C. 闭经－溢乳综合征
D. 空蝶鞍综合征
E. 多囊卵巢综合征

正确答案：A。Asherman综合征

解析：育龄期女性，人工流产术后闭经7个月，无腹痛，既往月经规律，尿妊娠试验阴性，基础体温双相型，最可能的诊断是Asherman综合征（A对），为子宫性闭经，多因人工流产刮宫过度或产后、流产后出血刮宫损伤子宫内膜，导致宫腔粘连而闭经。Sheehan综合征（B错）由于产后大出血休克，导致垂体尤其是腺垂体促性腺激素分泌细胞缺血坏死，引起腺垂体功能低下而出现一系列症状：闭经、无泌乳、性欲减退、毛发脱落等。闭经－溢乳综合征（C错）主要表现为闭经、溢乳、月经不调、月经减少，该患者既往月经正常且只存在闭经症状。空蝶鞍综合征（D错）蝶鞍膈因先天性发育不全、肿瘤或手术破坏，使脑脊液流入蝶鞍的垂体窝，使蝶鞍扩大，垂体受压缩小，称空蝶鞍。垂体柄受脑脊液压迫而使下丘脑与垂体间的门脉循环受阻时，出现闭经和高催乳素血症。多囊卵巢综合征（E错）：以长期不排卵及高雄激素血症为特征。临床表现为闭经、不孕、多毛和肥胖。